甲状腺开始发育的时间是
A. 胚胎第4周
B. 胚胎第5周
C. 胚胎第6周
D. 胚胎第7周
E. 胚胎第8周

正确答案：A。胚胎第4周

解析：胚胎第4周甲状腺始基（甲状舌管）下行，在甲状软骨处发育成甲状腺。掌握“甲状舌管囊肿”知识点。